肺炎球菌肺炎的痰液特征是
A. 粉红色泡沫样痰
B. 鲜红色痰
C. 棕褐色痰
D. 铁锈色痰
E. 灰黄色痰

正确答案：D。铁锈色痰

解析：肺炎球菌肺炎的痰液特征是铁锈色痰（D对）。粉红色泡沫痰（A错）是肺水肿的特征。鲜红色痰（B错）可见于呼吸道黏膜受侵害类疾病。棕褐色痰（C错）见于阿米巴肺脓肿。灰黄色痰（E错）可见于急性支气管炎。